甘草粉末显微特征有
A. 油室碎片
B. 草酸钙方晶
C. 纤维束及晶纤维
D. 具缘纹孔导管
E. 木栓细胞

正确答案：B、C、D、E。草酸钙方晶；纤维束及晶纤维；具缘纹孔导管；木栓细胞